来源于硫化物类矿物黄铁矿族黄铁矿的中药材是
A. 自然铜
B. 赭石
C. 磁石
D. 滑石
E. 炉甘石

正确答案：A。自然铜